重叠奔马律见于
A. 慢性心力衰竭
B. 三度房室传导阻滞
C. 肥厚性心肌病
D. 病窦综合征
E. 房早

正确答案：A。慢性心力衰竭

解析：重叠型奔马律为舒张早期和晚期奔马律在快速性心率或房室传导时间延长时在舒张中期重叠出现引起，使此额外音明显增强，可见于慢性心力衰竭（A对）。